进行人群高血压普查时应选择的疾病频率测量指标是
A. 发病率
B. 发病专率
C. 罹患率
D. 时点患病率
E. 期间患病率

正确答案：D。时点患病率

解析：本题考查普查中的指标。普查是指在特定时点或时期内、特定范围内的全部人群作为研究对象的调查，这个特定的时间段应尽可能短，获得的资料是患病率资料。患病率分为时点患病率（D对ABCE错）和期间患病率，时点患病率的观察时间较短，一般不超过一个月。因此通过高血压普查可获得时点患病率资料。